早期发现原位癌并加以手术是
A. 一级预防
B. 二级预防
C. 三级预防
D. 传染病的预防性措施
E. 传染病的防疫性措施

正确答案：B。二级预防

解析：本题考查二级预防的核心。第二级预防又称“三早”预防，即早发现、早诊断、早治疗。第二级预防是在疾病早期，症状体征尚未表现出来或难以觉察，通过及早发现并诊断疾病，及时给予适当的治疗，有更大的机会实现治愈。早期发现原位癌并加以手术是二级预防（B对ACDE错）。